新生儿早期患呼吸道感染的可能原因是
A. 补体成分缺陷
B. 先天免疫缺陷
C. 皮肤黏膜天然屏障差
D. SIgA合成不足
E. 呼吸道发育不良

正确答案：D。SIgA合成不足